反复感染的支气管扩张患者，在抗感染治疗时应覆盖的病原体是
A. 军团菌
B. 金黄色葡萄球菌
C. 肺炎球菌
D. 白色念珠菌
E. 铜绿假单胞菌

正确答案：E。铜绿假单胞菌

解析：支气管扩张患者反复肺部感染是因为扩张的支气管发生扭曲、变形，痰引流不畅导致的，尤其铜绿假单胞菌长期定植者容易发生，故在抗感染治疗时应覆盖铜绿假单胞菌（E对）。